与全口义齿后缘无关的解剖标志是
A. 腭小凹
B. 前颤动线
C. 后颤动线
D. 翼上颌切迹
E. 磨牙后垫

正确答案：B。前颤动线

解析：本题考查无牙颌的解剖标志。与全口义齿后缘无关的解剖标志是前颤动线（B错，为本题的正确答案）。上颌全口义齿的后缘应在腭小凹（A对）后2mm处。前颤动线和后颤动线（C对）之间为后提区，起边缘封闭的作用。上颌义齿的后缘两侧延伸至翼上颌切迹（D对）。下颌全口义齿的后缘盖过磨牙后垫1/2或全部，磨牙后垫（E对）可作为与下颌全口义齿后缘有关的解剖标志。